52岁妇女。绝经6年，阴道淋漓流血10天。查右附件区扪及手拳大肿物，阴道脱落细胞提示雌激素高度影响。本例最可能的诊断应是右侧卵巢
A. 纤维瘤
B. 浆液性囊腺瘤
C. 良性囊性畸胎瘤
D. 黏液性囊腺瘤
E. 卵泡膜细胞瘤

正确答案：E。卵泡膜细胞瘤

解析：52岁妇女，绝经6年，阴道淋漓流血10天，查右附件区扪及手拳大肿物（绝经妇女出现阴道不规则流血，且一侧附件区扪及肿物，首先考虑卵巢肿瘤），阴道脱落细胞提示雌激素高度影响（卵泡膜细胞瘤可产生较高水平的雌激素），综合患者的年龄、临床表现及细胞学检查，最可能诊断为卵泡膜细胞瘤（E对）。纤维瘤（A错）多有腹痛症状、偶见患者伴有腹水（八年制妇产科学P352）。浆液性囊腺瘤（B错）肿瘤不大时症状不明显，增大时可引起压迫症状，蒂扭转或肿瘤感染时可出现急性腹痛，有时可分泌一定量雌激素，肿瘤标志物和Ｂ超有助于诊断。良性囊性畸胎瘤（Ｃ错）多发生于30岁左右的育龄妇女，临床症状无特异性，主要表现是盆腔包块，破裂、扭转或出血会出现急腹痛，超声检查诊断率较高。黏液性囊腺瘤（Ｄ错）良性居多，多见于单侧，增大时可引起压迫症状。有时可分泌一定量雌激素，诊断多需要根据B超检查，并结合肿瘤标志物辅助诊断。